锁骨下动脉分支中没有
A. 椎动脉
B. 胸肩峰动脉
C. 甲状颈干
D. 胸廓内动脉
E. 无

正确答案：B。胸肩峰动脉

解析：胸肩峰动脉（B错，为本题正确答案）为腋动脉的分支。椎动脉（A对）、甲状颈干（C对）、胸廓内动脉（D对）均为锁骨下动脉的分支。